男，25岁。主因右膝关节肿痛2周就诊，腰痛3年。查体：右膝关节肿胀，有压痛，浮髌实验阳性，左侧“4字征”阳性，左侧骶髂关节压痛。最有意义的检查是
A. 骶髂关节X线片
B. 血沉
C. 类风湿因子
D. 抗“O”抗体
E. HLA-B27

正确答案：A。骶髂关节X线片

解析：青年男性患者（强直性脊柱炎的好发人群），右膝关节肿痛2周就诊，腰痛3年，查体：右膝关节肿胀、有压痛、浮髌实验阳性（膝关节炎体征），左侧“4字征”阳性、左侧骶髂关节压痛阳性（骶髂关节炎体征），本例患者考虑诊断为强直性脊柱炎，骶髂关节X线检查既可明确诊断，还可对强直性脊柱炎的严重程度进行分级，故该患者最有意义的检查是骶髂关节X线片（A对）。血沉（B错）为一般炎症指标，不具有特异性。类风湿因子（C错）阳性多见于类风湿关节炎，强直性脊柱炎为阴性。抗“O”抗体（D错）阳性见于风湿热、猩红热、丹毒等链球菌感染引发的疾病，强直性脊柱炎为阴性。约90%强直性脊柱炎患者HLA-B27（E错）阳性，但还有约10%患者HLA-B27阴性，故HLA-B27不是最有意义的检查。